女，46岁。因白带多半年，性交后出血1周就诊，宫颈刮片病理：宫颈鳞癌，浸润深度7mm，肉眼见癌灶最大直径≤4cm。宜选的手术方式是
A. 子宫全切术
B. 广泛性子宫切除术+盆腔淋巴结切除术
C. 放射治疗
D. 术后及放射综合治疗
E. 化疗

正确答案：B。广泛性子宫切除术+盆腔淋巴结切除术

解析：该患者为中年女性，出现接触性出血，宫颈刮片病理：宫颈鳞癌，浸润深度7mm，肉眼见癌灶最大直径≤4cm，诊断为子宫颈癌ⅠB1期，宜选的手术方式是广泛性子宫切除术+盆腔淋巴结切除术（B对）。子宫全切术（P308）（A错）用于ⅠA1期无淋巴脉管间隙浸润者。放射治疗（P308）（C错）适用于ⅠB2期和ⅡA2期和ⅡB～ⅣA期患者。术后及放射综合治疗（D错）、化疗（P308）（E错）主要用于晚期或复发转移患者和同期放化疗患者。